关于成釉细胞癌-原发型的说法不正确的是
A. 是一种少见的原发性牙源性恶性肿瘤
B. 肿瘤具有成釉细胞瘤的某些组织学特征
C. 无浸润性，包膜完整
D. 细胞异型性和核分裂增加
E. 表现明显分化不良

正确答案：C。无浸润性，包膜完整

解析：成釉细胞癌-原发型是一种少见的原发性牙源性恶性肿瘤，肿瘤具有成釉细胞瘤的某些组织学特征，但表现明显分化不良、细胞异型性和核分裂增加。掌握“成釉细胞癌”知识点。